利用扩散原理达到缓（控）释作用的方法是
A. 制成溶解度小的盐或酯
B. 与高分子化合物生成难溶性盐
C. 包衣
D. 控制粒子大小
E. 将药物包藏于溶蚀性骨架中

正确答案：C。包衣

解析：本题考查缓（控）释制剂。利用扩散原理达到缓（控）释作用的方法包括包衣（C对）、微囊化、制成不溶性的骨架片、制成植入剂、制成经皮吸收制剂、增加黏度以减小扩散速度。制成溶解度小的盐或酯（A错）、与高分子化合物生成难溶性盐（B错）、控制粒子大小（D错）均属于利用溶出原理达到缓（控）释作用。将药物包藏于溶蚀性骨架中（E错）属于利用溶蚀与扩散相结合原理达到缓（控）释作用。